等渗性脱水时机体表现为
A. 细胞内液降低，细胞外液降低
B. 细胞内液降低，细胞外液升高
C. 细胞内液降低，细胞外液正常
D. 细胞内液升高，细胞外液降低
E. 细胞内液变化不大，细胞外液降低

正确答案：E。细胞内液变化不大，细胞外液降低

解析：等渗性脱水时水钠成比例丢失，细胞外液渗透压仍在正常范围，细胞内外无水分转移，故细胞内液无明显变化（E对）。高渗性脱水时失水多于失钠，细胞内液向渗透压相对高的外液转移，细胞内外液均降低（A错）。低渗性脱水时细胞外液渗透压降低，细胞外液的水分向渗透压相对高的细胞内液转移，使细胞内液升高，细胞外液进一步降低（D错）。